阿拉伯胶可作为
A. 乳化剂
B. 助悬剂
C. 两者均是
D. 两者均不是

正确答案：C。两者均是

解析：本题考查表面活性剂。阿拉伯胶可作为乳化剂和助悬剂（C对）。乳化剂是能够改善乳浊液中各种构成相之间的表面张力，使之形成均匀稳定的分散体系或乳浊液的物质，阿拉伯胶为天然乳化剂；助悬剂指能增加分散介质的黏度以降低微粒的沉降速度或增加微粒亲水性的附加剂，阿拉伯胶为天然的高分子助悬剂。